两分子氨基酸可借一分子的氨基与另一分子的羧基脱去一分子水，此反应称为
A. 三羧酸循环
B. 缩水反应
C. 成肽反应
D. 裂解反应
E. 氧化还原反应

正确答案：C。成肽反应

解析：氨基酸的成肽反应：两分子氨基酸可借一分子的氨基与另一分子的羧基脱去一分子水、缩合成为最简单的肽。掌握“氨基酸与多肽及蛋白质结构”知识点。